奥美拉唑属于
A. CYP3A4抑制剂
B. CYP3A4诱导剂
C. CYP2C19底物药物
D. CYP1A2底物药物
E. CYP2D6抑制剂

正确答案：C。CYP2C19底物药物

解析：本题考查肝药酶抑制剂与诱导剂。CYP2C19底物药物（C对）有奥美拉唑、阿米替林、地西泮、奋乃静等。CYP3A4抑制剂（A错）有红霉素、西咪替丁、环丙沙星、克拉霉素、地尔硫䓬等。CYP3A4诱导剂（B错）有利福平、巴比妥类、卡马西平、依法韦仑、糖皮质激素、苯妥英钠等。CYP1A2底物药物（D错）有茶碱、阿米替林、氯丙嗪、氯氮平、氟奋乃静、丙咪嗪等。CYP2D6抑制剂（E错）有胺碘酮、阿米替林、塞来昔布、氯苯那敏、氯丙嗪、西咪替丁。